以下关于甲硝唑的描述不正确的是
A. 口服吸收差
B. 属硝基咪唑类药物
C. 对脆弱类杆菌尤为敏感
D. 对需氧菌或兼性需氧菌无效
E. 对破伤风梭菌具有很强的杀灭作用

正确答案：A。口服吸收差

解析：甲硝唑（灭滴灵）属硝基咪唑类药物，其分子中的硝基在细胞内无氧环境中被还原成氨基，从而抑制病原体DNA合成，发挥抗厌氧菌作用，对脆弱类杆菌尤为敏感。对滴虫、阿米巴滋养体以及破伤风梭菌具有很强的杀灭作用。但是，甲硝唑对需氧菌或兼性需氧菌无效。口服吸收良好，体内分布广泛，可进入感染病灶和脑脊液。掌握“磺胺类及甲硝唑”知识点。